依照《药品生产质量管理规范（1998年修订）》附录，注射剂浓配生产环境的空气洁净要求
A. 洁净度级别为100级
B. 洁净度级别为1000级
C. 洁净度级别为10000级
D. 洁净度级别为100000级
E. 洁净度级别为300000级

正确答案：C。洁净度级别为10000级